新生隐球菌的主要传播方式是
A. 病人-咯痰-飞沫传播
B. 鸽子-粪便-呼吸道传播
C. 病人-粪便-消化道传播
D. 病人-粪便-呼吸道传播
E. 人虱-粪便-破损皮肤传播

正确答案：B。鸽子-粪便-呼吸道传播

解析：新生隐球菌一般存在于鸽子的粪便当中，由人呼吸道吸入后引起感染。掌握“真菌概述及主要病原性真菌”知识点。